生化汤除活血化瘀，止痛外，还具有的功用是
A. 祛风
B. 温经
C. 行气
D. 疏肝
E. 除湿

正确答案：B。温经

解析：生化汤方证由产后血虚寒凝，淤血内阻所致。治以养血祛瘀，温经止痛（B对）。记忆：生化汤宜产后服，归芎桃草酒炮姜。